用糖皮质激素治疗病情可以得到改善的一组肾脏疾病是
A. 链球菌感染所致急性肾盂肾炎、系膜毛细血管性肾炎、狼疮性肾炎
B. 微小病变病、狼疮性肾炎、免疫性急性间质性肾炎
C. 紫癜性肾炎、遗传性肾炎、系膜增生性肾炎
D. 膜性肾病、局灶性节段性肾小球硬化、糖尿病肾病
E. 乙肝病毒相关性肾炎、肾淀粉样变性病、慢性间质性肾炎

正确答案：B。微小病变病、狼疮性肾炎、免疫性急性间质性肾炎

解析：微小病变病、狼疮性肾炎、免疫性急性间质性肾炎均可用糖皮质激素治疗，使病情得到改善（B对）。系膜毛细血管性肾炎激素治疗的效果常不明显（A错）。遗传性肾炎多采用肾移植、肾透析等方式治疗（C错）。膜性肾病和局灶性节段性肾小球硬化皮质类固醇治疗效果不佳（D错）。慢性间质性肾炎病理表现为肾组织纤维化和瘢痕的形成、肾盂肾盏变形，激素治疗无效（E错）。